克拉维酸是
A. 含青霉烷砜结构的药物
B. 含青霉烷结构的药物
C. 含碳青霉烯结构的药物
D. 含并四苯结构的药物
E. 含内酯环结构的药物

正确答案：B。含青霉烷结构的药物

解析：本题考查氧青霉烷类抗菌药。克拉维酸属于氧青霉烷类β-内酰胺酶抑制剂，含有青霉烷结构（B对）。含青霉烷砜结构（A错）的药物为青霉烷砜类抗生素，如舒巴坦。含碳青霉烯结构（C错）的为碳青霉烯类，如亚胺培南。含并四苯结构（D错）的药物主要为四环素类，如土霉素。含内酯环结构（E错）的为大环内酯类，如红霉素。